下列关于毒物靶器官的说法正确的是
A. 外源化学物可间接发挥毒作用的器官称为靶器官
B. 外源化学物可直接发挥作用的器官称为靶器官
C. 外源化学物可直接发挥毒作用的器官称为靶器官
D. 内源化学物可间接发挥毒作用的器官称为靶器官

正确答案：C。外源化学物可直接发挥毒作用的器官称为靶器官

解析：本题考查靶器官。外源化学物可直接发挥毒作用的器官称为靶器官（C对ABD错）。常见的靶器官有神经系统、血液和造血系统、生殖系统以及肝、肾、肺等。